氟硝西泮作用于
A. M受体
B. β受体
C. 5-HT受体
D. 多巴胺受体
E. 苯二氮䓬受体

正确答案：E。苯二氮䓬受体

解析：本题考查氯硝西泮。氟硝西泮作用于苯二氮䓬受体（E对）；作用于M受体（A错）的药物包括M受体激动药与M受体阻断药；作用于β受体（B错）的药物主要有异丙肾上腺素；作用于5-HT受体（C错）的药物有舍曲林、西酞普兰等；作用于多巴胺受体（D错）的药物有甲氧氯普胺。